舌根背面粘膜内的淋巴组织
A. 丝状乳头
B. 轮廓乳头
C. 舌扁桃体
D. 菌状乳头
E. 叶状乳头

正确答案：C。舌扁桃体

解析：舌扁桃体(C对)为舌根背面粘膜内的淋巴组织。